输卵管不通不孕症患者常配合的疗法是
A. 中药人工周期疗法
B. 西药人工周期
C. 针灸疗法
D. 气功疗法
E. 中药灌肠疗法

正确答案：E。中药灌肠疗法

解析：输卵管不通导致的不孕症，属于盆腔因素中的输卵管梗阻，根据不通则通的治法原则，应选用中药灌肠疗法（E对）。